根据《处方管理办法》，儿科处方的印刷用纸颜色为
A. 淡黄色
B. 淡红色
C. 淡绿色
D. 淡蓝色
E. 白色

正确答案：C。淡绿色

解析：本题考查处方颜色。根据《处方管理办法》，儿科处方的印刷用纸颜色为淡绿色（C对）。儿科处方的印刷用纸颜色为淡绿色，右上角标注“儿科”。急诊处方印刷用纸为淡黄色（A错）。麻醉药品和第一类精神药品处方印刷用纸为淡红色（B错）。普通处方的印刷用纸颜色为白色（E错）。